根据生物药剂学分类系统，属于第Ⅳ类低水溶性，低渗透性的药物是
A. 双氯芬酸
B. 吡罗昔康
C. 阿替洛尔
D. 雷尼替丁
E. 酮洛芬

正确答案：E。酮洛芬

解析：本题考查生物药剂学分类系统。酮洛芬（E对）属于第Ⅳ类低水溶性，低渗透性的药物。生物药剂学分类系统根据药物溶解性和肠壁渗透性的不同组合将药物分为四类：第Ⅰ类是高水溶解性、高渗透性的两亲性分子药物，其体内吸收取决于胃排空速率，如依那普利、地尔硫䓬。第Ⅱ类是低水溶性、高渗透性的亲脂性分子药物，其体内吸收取决于溶解速率，如双氯芬酸（A错）、吡罗昔康（B错）。第Ⅲ类是高水溶解性、低渗透性的水溶性分子药物，其体内吸收受渗透效率影响，如雷尼替丁（D错）、阿替洛尔（C错）。第Ⅳ类是低水溶解性、低渗透性的疏水性分子药物，其体内吸收比较困难，如特非那定、酮洛芬、呋塞米等。